某女，65岁，糖尿病史8岁，刻下口渴引饮，小便频数，多食善饥，肢体消瘦，体倦乏力，睡眠欠佳，腰膝酸痛；舌淡红，苔白而干，脉细弱。四诊合参，辨析其证候是
A. 脾胃气虚
B. 气阴两虚
C. 阴虚燥热
D. 胃阴不足
E. 阴阳两虚

正确答案：B。气阴两虚

解析：本题考查的是消渴的辨证论治。糖尿病史8岁，刻下口渴引饮，小便频数，多食善饥，肢体消瘦，体倦乏力，睡眠欠佳，腰膝酸痛；舌淡红，苔白而干，脉细弱。四诊合参，辨析其证候是气阴两虚（B对）。消渴是以多饮、多食、多尿、乏力、消瘦，或尿有甜味为主要临床表现的疾病。其中以口渴多饮为主者称为“上消”；消谷善饥为主者称为“中消”；小溲多而频，或浑浊为特点的称为“下消”。三者也可并见。西医学的糖尿病、尿崩症和精神性多饮、多尿症等以上述临床表现为主者，可参考此内容辨证论治。（一）阴虚燥热证（C错）：【症状】烦渴引饮，消谷善饥，小便频数而多，尿浑而黄，形体消瘦。舌红，苔薄黄，脉滑数。（二）脾胃气虚证（A错）：【症状】口渴引饮，能食与便溏并见，或饮食减少，精神不振，四肢乏力。舌淡，苔薄白而干，脉细弱无力。（三）气阴两虚证：【症状】口渴引饮，咽干口燥，多食善饥，倦怠乏力，便溏溲多，或形体消瘦。舌质淡红，苔白而干，脉弱。（四）肾阴亏虚证：【症状】尿频量多，浊如膏脂，腰酸膝软，头晕耳鸣，多梦遗精，乏力，皮肤干燥。舌红少苔，脉细数。（五）阴阳两虚证（E错）：【症状】小便频数，甚则饮一溲一，咽干舌燥，面容憔悴，耳轮干枯，腰膝酸软，畏寒肢冷。舌淡，苔白少津，脉沉细无力。辨证为胃阴不足（D错）的疾病，2022年考试指南未明确说明。